军团病一年四季均可发病，但暴发流行多见于
A. 春夏季
B. 夏秋季
C. 秋冬季
D. 冬春季
E. 冬季

正确答案：B。夏秋季

解析：本题考查军团病暴发流行的季节。军团病是由嗜肺军团菌引起的一种以肺炎为主的全身性疾病，以肺部感染伴全身多系统损伤为主要表现，也可表现为无肺炎的急性自限性流感样疾病。军团病一年四季均可发病，但暴发流行多见于夏秋季（B对ACDE错）。